生命价值论指的是
A. 生命神圣与人道论的统一
B. 生命神圣与生命质量的统一
C. 美德论与义务论的统一
D. 生命质量与生命价值论的统一
E. 义务论与公益论的统一

正确答案：B。生命神圣与生命质量的统一

解析：把生命神圣与生命质量相统一的崭新的生命伦理观，即生命价值论正在成为当代医学道德的主导思想，成为当代人类对人的生命干预的主要依据。人的生命价值就是人的生命具有的满足人的需要的效用性。生命价值论把人的生命的价值作为应该如何对待人的生命的尺度（B对）。